具有肠脂垂、结肠带、结肠袋3大特征的是
A. 空肠
B. 回肠
C. 降结肠
D. 直肠
E. 肛管

正确答案：C。降结肠

解析：具有肠脂垂、结肠带、结肠袋3大特征的为盲肠和结肠(C对)。